男，28岁。心悸、无力、手颤抖3个月，大便每日2～3次，不成形。体重下降5kg，1周前诊断为甲状腺功能亢进症，尚未治疗，昨晚饮白酒半斤，呕吐1次，晨起醒来发现双下肢不能活动。为明确下肢不能活动的原因首先应测定
A. 血钠
B. 血镁
C. 血糖
D. 血钾
E. 血钙

正确答案：D。血钾

解析：患者为青年男性，有甲亢病史，呕吐后发现双下肢不能活动，提示可能出现甲亢性周期性瘫痪。（甲亢性周期性瘫痪是指甲亢病人出现的肢体双侧对称性瘫痪，下肢较重，在亚洲青壮年男性中多见。通常由低血钾引发。）甲亢时，过多的甲状腺激素可促进Na⁺-K⁺泵活性，使K⁺向细胞内转移，导致血钾降低，进一步引发周期性瘫痪。因此，为明确该患者下肢不能活动的原因，首先应测定血钾（D对）。血钠（A错）、血镁（B错）、血糖（C错）、血钙（E错）测定不能明确该患者双下肢不能活动的原因。